心电图是
A. 在心肌细胞表面记录的生物电变化
B. 在心肌细胞内记录的生物电变化
C. 在心脏表面记录的心电向量变化
D. 在体表记录心脏电变化引起的电场电位变化
E. 在体表记录的心脏舒缩活动

正确答案：D。在体表记录心脏电变化引起的电场电位变化